成人血清钠检测值为125mmol/L，估计每公斤体重缺氯化钠的量为
A. 0.10～0.35g
B. 0.35～0.70g
C. 0.70～1.05g
D. 1.05～1.35g
E. 1.35～1.65g

正确答案：B。0.35～0.70g

解析：患者成年男性，其血清钠检测值为125mmol/L，而正常成年人的血钠正常值范围为135mmol/L～150mmol/L，提示为低渗性缺水。低渗性缺水的补钠量可按下列公式计算：需补充的钠量（mmol）=[血钠的正常值（mmol/L）-血钠测得值（mmol/L）]×体重（kg）×0.6（女性0.5）。①故患者每公斤需补充的钠量最小值为[135mmol/L－125mmol/L]×0.6=6mmol；最大值为[145mmol/L－125mmol/L]×0.6=12mmol，即患者每公斤体重需钠量为6mmol～12mmol。由于每17mmolNa⁺相当于1g钠盐，故成年男性每公斤体重需钠盐为0.35g～0.7g（B对）。②事实上，计算时常取中间值142mmol计算，即为[142mmol/L－125mmol/L]×0.6=10.2mmol，相当于0.6g氯化钠。